对于直肠内高位带蒂息肉，最合理的切除方式是
A. 经肛门用丝线从根部结扎切
B. 腹腔镜直肠部分切除
C. 剖腹行局部切除术
D. 经肛门用血管钳钳夹切除
E. 内镜下高频电切除

正确答案：E。内镜下高频电切除

解析：直肠内高位带蒂息肉，因位置较高，需在内镜下显露息肉，用圈套器套住蒂部高频电灼切除（E对）。经肛门用丝线从根部结扎切除（A错）、经肛门用血管钳钳夹切除（D错）适用于直肠低位息肉。腹腔镜直肠部分切除（B错）、剖腹行局部切除术（C错）适用于内镜下难以切除、位置较高的癌变息肉，或直径＞2cm的广基息肉。